下列哪一项不是维生素D的理化性质
A. 溶于脂肪及脂溶剂
B. 对热不稳定
C. 能抵抗碱及氧
D. 在紫外线照射下，可在皮肤内合成
E. 是具有胆钙化醇生物活性的类固醇

正确答案：B。对热不稳定